贲门周围血管离断术需离断的血管中不包括
A. 胃冠状静脉
B. 胃短静脉
C. 胃网膜右静脉
D. 胃后静脉
E. 左膈下静脉

正确答案：C。胃网膜右静脉

解析：贲门周围血管离断术需离断胃冠状静脉（A对）、胃短静脉（B对）、胃后静脉（D对）、左膈下静脉（E对）。胃网膜右静脉（C错，为本题正确答案）沿胃大弯右侧分布，距离贲周远，贲门周围血管离断术不需离断该血管。